已婚妇女，32岁。1年前曾人工流产并行绝育术，近3月阴道不规则流血，妇科检查：子宫稍大双附件区未查异常，尿HCG（+），胸片见右肺有1cm直径的两个阴影，边缘模糊。首选处理应为
A. 刮宫术
B. 后穹隆穿刺术
C. 子宫全切术
D. 化学药物治疗
E. 腹腔镜检查

正确答案：D。化学药物治疗

解析：患者为年轻妇女，1年前曾人工流产（非葡萄胎妊娠后只继发绒癌），近3月阴道不规则流血（滋养细胞肿瘤表现为在葡萄胎排空、流产或足月产后，有持续的不规则阴道流血，量多少不定），妇检：子宫稍大（子宫复旧不全或不均匀性增大），双附件区未查异常，尿hCG（﹢）（足月产、流产和异位妊娠后hCG多在4周左右转为阴性），胸片见右肺有1cm直径的两个阴影，边缘模糊（肺转移的最初X线征象为肺纹理增粗，以后发展为片状或小结节阴影，典型表现为棉球状或团块状阴影。转移灶以右侧肺及中下部较为多见），应考虑为绒毛膜癌。绒毛膜癌对化疗高度敏感，是目前可通过化疗（D对）治愈的少数几个恶性肿瘤之一。刮宫术（P337）（A错）主要用于葡萄胎的治疗。后穹窿穿刺（B错）主要用于诊断宫外孕破裂、盆腔感染等。子宫全切术（P342）（C错）用于无生育要求且无转移的绒毛癌患者。腹腔镜（E错）虽能用于子宫外转移灶组织的活检，结合组织学检查可诊断妊娠滋养细胞肿瘤，但由于创伤大且易诱发转移，不作为首选的检查方法。